哪些不是日常生活接触传播的传染病特点
A. 可形成家庭聚集现象
B. 病例多呈散发
C. 无明显季节高峰
D. 夏季多发

正确答案：D。夏季多发

解析：本题考查日常生活接触传播的概念。日常生活接触传播，又称为间接接触传播，其流行特征为：①病例多呈散发（BC对），但可在家庭或同住者之间传播而呈现家庭和同住者中病例聚集（A对）的现象；②卫生条件差、卫生习惯不良的人群中病例较多。日常生活接触传播没有明显的季节性，不会出现夏季多发（D错，为本题正确答案）的现象。